下面哪种情况禁用β受体阻断药
A. 心绞痛
B. 快速性心律失常
C. 高血压
D. 重度房室传导阻滞
E. 甲状腺机能亢进

正确答案：D。重度房室传导阻滞

解析：β受体阻断药禁忌证：禁用于严重左室心功能不全、窦性心动过缓、重度房室传导阻滞和支气管哮喘的病人。心肌梗死病人及肝功能不良者应慎用。掌握“β肾上腺素受体阻断剂”知识点。